引起细菌性痢疾患者出现腹痛，里急后重等症状的细菌成分是
A. 0抗原
B. H抗原
C. 菌毛
D. 内毒素
E. 外毒索

正确答案：D。内毒素